下列各项，除哪项外，其属性均可用阴阳区分
A. 寒凉与温热
B. 抑制与兴奋
C. 外与内
D. 水与火
E. 上升与入内

正确答案：E。上升与入内

解析：阴阳，既可以标示相互对立的事物或现象，又可以标示同一事物或现象内部对立的两个方面。前者如天与地，日与月，水与火（D对）等；后者如寒与热（A对），动与静，升与降，一般来说，凡是运动的、外向的、上升的、弥散的、温热的、明亮的、兴奋的都属于阳；相对静止的、内守的（C对）、下降的、凝聚的、寒冷的、晦暗的、抑制的（B对）都属于阴。（E错，为本题正确答案）。